现有60例心脏移植患者，随访观察其术后5年存活情况，其中2例由于迁居国外而失访，36例在随访结束时存活，而20例在随访期中由于心脏原因发生死亡，2例由于意外事故发生死亡。上述实例中的删失率为
A. 0.0333
B. 0.6667
C. 0.6
D. 0.64
E. 0.0667

正确答案：B。0.6667

解析：本题考查删失率。本题中的删失率＝（2＋36＋2）/60＝66.67%（B对ACDE错）。